女孩，2岁，母有哮喘史，患儿幼时花粉过敏，反复发作喘息4次以上，昨又突然发作喘息，查两肺满布哮鸣音，皮下注射肾上腺素后，哮鸣音明显减少。患儿哮喘诊断的评分是
A. 12分
B. 10分
C. 8分
D. 6分
E. 4分

正确答案：B。10分

解析：凡年龄在3岁以内、哮喘反复发作者的计分原则：①哮喘发作≥3次，计3分；②肺部出现哮鸣音，计2分；③喘息突然发作，计1分；④有其他特应性病史，计1分；⑤1级2级亲属中有哮喘病史，计1分。总分≥5分者诊断为婴幼儿哮喘；如肺部有哮鸣音可做以下试验；（1）1‰肾上腺素每次0.01mg/kg皮下注射，15~20分钟后若喘息缓解或哮鸣音明显减少者加2分；（2）予以舒喘灵气雾剂或其水溶液雾化吸入后，观察喘息或哮鸣音改变情况，如减少明显者可加2分。该患儿，2岁，反复发作喘息4次以上，计3分；查两肺满布哮鸣音，计2分；昨又突然发作喘息，计1分；患儿幼时花粉过敏，计1分；母有哮喘史，即1级亲属有哮喘病史，计1分；总共计分8分。总分≥5分可诊断为婴幼儿哮喘，因肺部有哮鸣音，肾上腺素注射后哮鸣音明显减少，则加上2分。因此最终该患儿的评分为10分（B对）。